男，33岁，右上腹外伤2小时。查体：P120次/分，R28次/分，BP90/60mmHg。全腹有压痛、反跳痛，以右上腹为著，移动性浊音（+）。最有意义的辅助检查是
A. 腹部B超
B. 立位腹部X线平片
C. 腹部CT
D. 诊断性腹腔穿刺
E. 腹部MRI

正确答案：D。诊断性腹腔穿刺

解析：青年男性患者，右上腹外伤后全腹压痛、反跳痛，P120次/分（正常为60～100次/分），BP90/60mmHg（正常为90～139/60～89mmHg，已达正常下限，脉快、血压下降提示腹腔内出血），移动性浊音（+）（提示腹腔内实质性器官破裂出血），结合患者病史和临床表现，应诊断为腹部闭合性损伤伴实质性脏器损伤。为明确诊断，最有意义的辅助检查是诊断性腹腔穿刺（D对）。诊断性腹腔穿刺在腹部损伤患者中的阳性率可达90％以上，对判断哪种脏器损伤具有重要价值。腹部B超（A错）多用于腹部实质性脏器损伤的诊断，对于空腔脏器损伤的检出率较低；腹部X线平片（B错）对腹腔空腔脏器损伤有一定的诊断价值；腹部CT（C错）对实质性脏器损伤有重要的诊断价值，上述检查均有一定的局限性，对腹部损伤的诊断价值不及腹腔穿刺。腹部MRI（E错）对血管损伤和某些特殊部位的损伤如十二指肠壁间血肿具有较高的诊断价值，但价格昂贵、操作复杂，较少使用。